水体受有机物污染的代表性指标是
A. COD
B. BOD
C. DO
D. TOD
E. TOC

正确答案：E。TOC

解析：本题考查总有机碳的相关内容。总有机碳（TOC）（E对ABCD错）是以碳的含量表示水中有机物的总量，结果以碳（C）的质量浓度（mg/L）表示。碳是一切有机物的共同成分，组成有机物的主要元素，水的TOC值越高，说明水中有机物含量越高，因此，TOC可以作为评价水质有机污染的指标。